医师在执业活动中，有下列行为之一的，由县级以上人民政府卫生行政部门给予警告或者责令暂停六个月以上一年以下执业活动，情节严重的，吊销其执业证书，除了
A. 由于不负责任延误急危病重患者的抢救和诊治，造成严重后果的
B. 未经亲自诊查、调查，签署诊断、治疗或者出生、死亡等证明文件的
C. 使用未经批准使用的药品、消毒药剂和医疗器械的
D. 使用麻醉药品、医疗用毒性药品、精神药品和放射性药品的
E. 隐匿、伪造或者擅自销毁医学文书及有关资料的

正确答案：D。使用麻醉药品、医疗用毒性药品、精神药品和放射性药品的